参与颅前窝组成的骨为
A. 额骨、顶骨、颞骨
B. 蝶骨、枕骨、额骨
C. 筛骨、额骨、蝶骨
D. 筛骨、犁骨、蝶骨
E. 无

正确答案：C。筛骨、额骨、蝶骨

解析：颅前窝由额骨眶部、筛骨筛板和蝶骨小翼构成（C对）。